除水分子外，基本上没有其他化学成分的水是
A. 井水
B. 纯水
C. 净水
D. 矿泉水
E. 直饮水

正确答案：B。纯水

解析：本题考查纯水。纯水（B对ACDE错）是以市政自来水为原水，经初步净化、软化（视原水硬度而定），主要采用反渗透电渗析蒸熘等工艺使水中溶解的矿物质以及其他有害物质全部去除，其电导率小于1μs/cm，浊度小于1度，即除水分子外基本上没有其他化学成分。